与细菌抵抗吞噬有关的是
A. 荚膜
B. 芽胞
C. 鞭毛
D. 菌毛
E. 异染颗粒

正确答案：A。荚膜

解析：荚膜菌在其细胞壁外有一层厚＞0.2nm而黏稠的结构称为荚膜，其化学成分在多数菌为多糖，少数菌为多肽。荚膜具有黏附宿主细胞和抗吞噬等致病作用以及抗原性，并且是鉴别细菌的指征之一。掌握“细菌的特殊结构及检查方法”知识点。